小儿指纹色紫主证为
A. 燥
B. 热
C. 寒
D. 滞
E. 瘀

正确答案：B。热

解析：小儿指纹的辨证纲要可归纳为“浮沉分表里，红紫辨寒热，淡滞定虚实，三关测轻重”。故小儿指纹色紫主证为热（B对）。燥邪为病从指纹上不易判断（A错）。纹色鲜红浮露，多为外感风寒，属寒证（C错）。指纹色紫推之滞涩，复盈缓慢，主实邪内滞，属滞（D错）。纹色青紫，多为瘀热内结，属瘀（E错）。